对患者不会造成伤害的是
A. 医务人员的知识和技能低下
B. 医务人员的行为疏忽和粗枝大叶
C. 医务人员强迫患者接受检查和治疗
D. 医务人员对患者呼叫或提问置之不理
E. 医务人员为治疗疾病适当地限制或约束患者的自由

正确答案：E。医务人员为治疗疾病适当地限制或约束患者的自由